肺硅沉着病的特征性病理改变是
A. 矽结节
B. 肺间质纤维化
C. 圆形小阴影
D. 肺泡结构破坏
E. 肺脏体积增大，含气量减少

正确答案：A。矽结节

解析：肺硅沉着病（简称硅肺）是长期吸入含游离二氧化硅（SiO₂）粉尘沉着于肺组织所引起的一种职业病，其基本病理改变是硅结节的形成和肺组织的弥漫性纤维化，其中矽（硅）结节（A对）最具特征性，在X线下表现为圆形小阴影（C错）。肺间质纤维化（B错）无特征性，除硅肺外还可见于特发性肺纤维化、肺结核等疾病等。肺泡结构破坏（D错）和肺脏体积增大，含气量减少（E错）均无特异性，可见于多种肺部疾病，如某些肺炎、肺水肿等。